高科技应用在医学中所带来的医学难题是
A. 布局不合理
B. “植物人”的治疗决策
C. 卫生资源浪费严重
D. 其使用背离医学目的
E. 影响医学人才全面发展

正确答案：B。“植物人”的治疗决策